义齿初戴造成发音不清晰的原因不包括下列哪项
A. 刚刚戴入义齿，没有适应
B. 牙齿排列偏向舌侧
C. 上颌腭侧基托过厚
D. 卡环或者其他固位体过紧
E. 下颌舌侧基托过度伸展

正确答案：D。卡环或者其他固位体过紧

解析：由于义齿戴上后，缩小了口腔空间，舌活动受限，有暂时性的不适应，常造成发音障碍。经过一段时间练习，多数患者可逐渐习惯不影响发音，只需向患者解释清楚即可。如因基托过厚、过大，牙齿排列偏向舌侧，应将基托磨薄、磨小或调磨人工牙的舌面，以改善发音。掌握“局部义齿修复后出现的问题及处理”知识点。